当我们思考“什么是道德”等理论问题时，属于
A. 抽象思维
B. 具体形象思维
C. 聚合思维
D. 发散思维
E. 创造性思维

正确答案：A。抽象思维